大连接体所起的作用中，不包括
A. 连接义齿各部件
B. 起支持、稳定作用
C. 增加义齿强度
D. 传导力和分散力量
E. 利于人工牙的排列

正确答案：E。利于人工牙的排列

解析：大连接体的作用：连接义齿各部分成一整体，传递和分散（牙合）力至基牙和邻近的支持组织，以减少基牙在功能状态时所承受的扭力和负荷。因使用大连接体，可减小基托面积，并可增加义齿的强度。掌握“局部义齿固位体”知识点。